B细胞表面出现哪一种smIg是成熟标志之一
A. IgG1
B. IgG2
C. IgA
D. IgD
E. IgE

正确答案：D。IgD